为考核新研制的甲肝疫苗的预防免疫效果，在某村7岁易感儿童进行甲肝疫苗免疫接种。经3年随访观察，接种甲肝疫苗的500人中，出现1例甲肝病例。在未接种的500人中，有10人发生甲肝，则下列说法正确的是
A. 该疫苗的保护率是10
B. 该疫苗的效果指数为9
C. 该研究的主要结局是甲肝的发生率
D. 无法计算该疫苗的效果指数，但可以计算保护率
E. 无法计算该疫苗的保护率，但可以计算效果指数

正确答案：C。该研究的主要结局是甲肝的发生率

解析：本题考查实验流行病学评价预防措施效果的主要指标。本题中该研究只能得出该研究的主要结局是甲肝的发生率（C对ABDE错），无论是保护率还是效果指数均因对照组和实验组的发病率无法得知而求不得。